不符合妄想特征的是
A. 内容与客观现实不符合
B. 是一种病理的信念
C. 内容多与患者自身相关
D. 内容受文化背景影响
E. 受教育越高越容易出现

正确答案：E。受教育越高越容易出现

解析：妄想内容与患者的文化背景和经历有关，与受教育程度无关（E错，为本题正确答案）。妄想是在病态推理和判断基础上形成的一种病理性的歪曲的信念（B对）。其特征包括：①妄想内容与客观现实不符（A对）；②妄想内容多与患者自身相关（C对）；③妄想内容受患者文化背景影响（D对）；④妄想内容具有个体独特性，是个体的心理现象，并非集体信念。